下列药材的伪品中质硬不易折断，断面角质样，可见由小点断续排列成的多个同心环纹
A. 柴胡伪品
B. 山药伪品
C. 天麻伪品紫茉莉干燥根
D. 何首乌伪品毛廖脉的块根
E. 川贝母伪品

正确答案：C。天麻伪品紫茉莉干燥根

解析：本题考查的是天麻的伪品。下列药材的伪品中质硬不易折断，断面角质样，可见由小点断续排列成的多个同心环纹天麻伪品紫茉莉干燥根（C对）。天麻伪品紫茉莉干燥根：呈长圆锥形，稍弯曲，多已压扁；表面有扭曲的纵沟纹和支根痕；质坚硬，断片黄白色，角质状，可见点状维管束呈同心环状排列。柴胡伪品（A错）大叶柴胡干燥根茎及根：本品为圆柱略弯曲，常有分枝，下部分枝较多，质坚硬，断面平整呈黄白色，皮部与木部紧连，中心多空洞，显纤维性，味微涩，有麻舌感，有芹菜样气味。山药伪品（B错）木薯大戟科植物木薯块根：块根呈圆柱形，常切成斜片。外皮多已除去，有的残存黑褐色及棕褐色的外皮，切断面乳白色，粉性，近边缘处可见形成层的环纹。中央部位有木心（导管群），有的有裂隙，由木心向四周扩散有黄色小点散在，有的呈放射状及环状散在的导管，味谈，嚼之有纤维感。何首乌伪品毛脉蓼的块根（D错）毛脉蓼：块根呈卵形，表皮棕褐色，质坚硬，断面不平，土黄色，偶有不明显云锦纹及黄色纤维状脉纹。气略香，味微苦。川贝母伪品（E错）平贝母的干燥鳞茎：表面黄白色至浅棕色，外层鳞叶2瓣，肥厚，大小相近或一片稍大抱合，顶端略平或微凹入，常稍开裂；中央鳞片小。质坚实而脆，断面粉性。